牙冠形成后摄入四环素，临床上能够看到牙齿颜色的部位是
A. 牙骨质
B. 牙釉质
C. 牙本质
D. 牙髓
E. 无变色

正确答案：E。无变色

解析：四环素牙的变色程度受摄入四环素时间的影响，若在牙冠已经形成以后摄入药物，四环素局限于牙根，临床观察不到变色。掌握“四环素牙”知识点。